女，65岁。跌倒，臀部着地，当即腰部疼痛，不能活动。首选的检查方法是
A. X线片
B. CT
C. MRI
D. 超声检查
E. 核素扫描

正确答案：A。X线片

解析：老年女性患者，臀部外伤史后，腰部疼痛不能活动，应考虑有骨折可能。为明确诊断，首选的检查方法是X线片（A对）。X线片能较清晰的显示骨折，且经济、方便，故为诊断各种骨折的首选方法。CT（B错）、MRI（C错）虽然对骨折的分辨率较高，但是价格昂贵，一般不作为首选检查。超声检查（D错）无法穿透成人皮质骨，故难于诊断骨骼疾病，对骨折的诊断意义不大。核素扫描（E错）常用于恶性肿瘤骨转移的诊断。